抗前列腺增生药非那雄胺所致不良反应
A. 粒细胞计数减少
B. 体位性低血压
C. 性功能降低
D. 淋巴结肿大
E. 视物模糊

正确答案：C。性功能降低

解析：本题考查药物不良反应。抗前列腺增生药物非那雄胺的主要不良反应有：性功能减退（C对）、射精障碍、瘙痒、皮疹、乳房增大等。粒细胞减少（A错）、体位性低血压（B错）、淋巴结肿大（D错）、视物模糊（E错）均不是非那雄胺的不良反应。